以下关于上颌窦癌的叙述，哪项是错误的
A. 以鳞癌为最常见
B. 早期无症状而不易发觉
C. 肿瘤发生部位不同可出现不同临床症状（如鼻塞、复视、张口受限等）
D. 早期即有明显的骨质破坏
E. 远处转移较少见

正确答案：D。早期即有明显的骨质破坏

解析：上颌窦癌为鼻旁鳞癌中的最常见者。位于上颌窦内，早期无症状不容易发觉。当肿瘤发展到一定程度，出现各种不同的症状：位于上颌窦内壁-鼻塞、鼻出血、单侧鼻腔分泌物增多、鼻泪管堵塞流泪；位于上颌窦上壁-眼球突出、向上移位，引起复视；位于上颌窦外壁-唇颊沟肿胀，破溃后肿瘤外露，眶下神经受损引起面颊部感觉迟钝；位于上颌窦后壁-侵入翼腭窝造成张口困难；位于上颌窦下壁-牙松动、疼痛、龈颊沟肿胀等症状。晚期转移至上颌窦的任何部位。引起相应的临床症状。远处转移少见。掌握“中央性颌骨癌及上颌窦癌”知识点。